循环性缺氧时血氧指标最具特征的变化是
A. 动脉血氧分压正常
B. 动脉血氧容量正常
C. 动脉血氧含量正常
D. 动脉血氧饱和度正常
E. 动-静脉氧含量差增大

正确答案：E。动-静脉氧含量差增大

解析：与其他缺氧类型的血氧变化特点相比，动-静脉血氧含量差增大（E对）是循环性缺氧最具有特征的血氧指标。动脉血氧分压正常（A错）、动脉血氧容量正常（B错）、动脉血氧含量正常（C错）、动脉血氧饱和度正常（D错）都不是循环性缺氧时血氧指标最具特征的变化。